麻黄的功效是
A. 发汗、平喘
B. 祛风解表、透疹
C. 温肺止咳
D. 祛风燥湿、消肿排脓
E. 解痉

正确答案：A。发汗、平喘

解析：本题考查的是麻黄的功效。麻黄的功效是发汗、平喘（A对）。麻黄：【功效】发汗解表，宣肺平喘，利水消肿。荆芥：【功效】散风解表，透疹（B错）止痒，止血。生姜：【功效】发汗解表，温中止呕，温肺止咳（C错）。白芷：【功效】发散风寒，通窍止痛，燥湿止带，消肿排脓（D错）。防风：【功效】祛风解表，胜湿，止痛，解痉（E错）。